30岁，女性。停经41天，突发右下腹撕裂样疼痛1小时就诊，伴里急后重感及心慌。查体：血压80/40mmhg，脉搏114次/分，下腹压痛、反跳痛明显，移动性浊音(﹢），宫颈举痛，后穹隆饱满，子宫如40天妊娠大小，附件区触诊不满意。B超示右附件包块，盆腔积液。最可能的诊断是
A. 难免流产
B. 卵巢肿瘤蒂扭转
C. 急性盆腔炎
D. 输卵管妊娠破裂
E. 急性阑尾炎

正确答案：D。输卵管妊娠破裂

解析：30岁，女性。有停经史，突发右下腹撕裂样疼痛（输卵管妊娠流产或破裂时，突感一侧下腹部撕裂样疼痛）。查体：血压80/40mmHg，脉搏114次/分（血压下降，心率增快，腹腔内出血较多时的休克表现），移动性浊音(﹢），宫颈举痛，后穹隆饱满（血液积聚于直肠子宫陷凹处的临床表现），B超示右附件包块，盆腔积液。综合该患者的月经史、临床表现及影像学检查首先考虑输卵管妊娠破裂（D对）。难免流产（A错）指流产不可避免，妇科检查宫颈口已扩张，不会出现宫颈举痛。卵巢肿瘤蒂扭转（B错）有体位改变诱发，无宫颈举痛。急性盆腔炎（C错）不会出现突然的撕裂样疼痛。急性阑尾炎（E错）主要症状为转移性右下腹痛，不会出现宫颈举痛体征